心力衰竭患者心率加快是由于
A. 交感-肾上腺髓质系统兴奋
B. 肾素-血管紧张素-醛固酮系统兴奋
C. 两者均有
D. 两者均无
E. 无

正确答案：A。交感-肾上腺髓质系统兴奋

解析：心衰时，心排血量减少，通过激活颈动脉窦和主动脉弓压力感受器使交感-肾上腺髓质系统兴奋（A对），使心率增快。同时，因心排血量减少导致的肾脏低灌流和交感神经系统兴奋均可兴奋肾素-血管紧张素-醛固酮系统（B错），使醛固酮分泌增加引起钠水潴留以维持心排血量正常，但没有使心率加快。